一位38岁的男患者，右下67间牙龈反复肿胀半年，应做的进一步检查，除了
A. 不良修复体或充填体
B. 右下67接触关系
C. 右下67牙冠外形
D. 对颌牙齿情况
E. 咬合力量的测定

正确答案：E。咬合力量的测定

解析：本题考查食物嵌塞的检查。若考虑食物嵌塞，进一步检查，不必做咬合力量的测定（E错，为本题的正确答案），因为食物嵌塞主要由牙齿形态不良，尤其是邻面接触区形态不良导致，与咬合力量的大小无关，咬合力量的大小以及咬合关系与咀嚼效率相关。而应进行的进一步检查包括：检查有无不良修复体或充填体（A对）。检查右下67接触关系（B对）如邻面接触区是否增宽、颊舌外展隙是否变窄等。检查右下67牙冠外形（C对）如（牙合）面及边缘嵴有无磨损、斜嵴是否有改向等。检查对颌牙齿情况（D对）如对颌牙齿有无充填式牙尖或尖锐边缘嵴等。除此之外，还应检查有无牙松动、移位、缺牙或排列不齐等情况，并用探针检查嵌塞部位有无纤维性食物残渣，牙齿有无邻面龋。